当平均动脉血压下降到80mmHg以下时将导致
A. 蛋白尿
B. 血尿
C. 尿糖
D. 少尿
E. 尿量不变

正确答案：D。少尿